下列各项中核酸类型为单股负链RNA的病毒是
A. HAV
B. HBV
C. HCV
D. HDV
E. HEV

正确答案：D。HDV

解析：丁型肝炎病毒（HDV）为球状，直径为35～37nm，核心为单股负链RNA（-ssRNA），基因组仅有1.7kb长，是已知动物病毒中最小的基因组。掌握“丙型、丁型、戊型肝炎病毒”知识点。